下面说法正确的是
A. 气体在肺泡中分压越低，越易吸收
B. 血/气分配系数越小，越易吸收
C. 脂/水分配系数越大，越不易吸收
D. 通气/血流比值越大，越不易吸收
E. 以上均不正确

正确答案：E。以上均不正确